PSI指数的参数不包含
A. SO₂
B. O₃
C. NO₂
D. NO
E. CO

正确答案：D。NO

解析：本题考查PSI指数的参数。PSI指数的参数包含SO₂（A对）、NO₂（C对）、CO（E对）、O₃（B对）、颗粒物，以及颗粒物与SO₂的乘积。NO（D错，为本题正确答案）不属于PSI指数的参数。